常与其他降压药合用防止水钠潴留的药物是
A. 硝苯地平
B. 可乐定
C. 普萘洛尔
D. 硝普钠
E. 氢氯噻嗪

正确答案：E。氢氯噻嗪

解析：氢氯噻嗪单用适用于轻、中度高血压，与其他抗高血压药联合，可用于治疗中、重度高血压，同时还能防止其他降压药引起的水钠潴留，尤其适用于伴有心力衰竭的高血压患者（E对）。